治疗遗尿伴夜梦多，除主穴外，应加
A. 肾俞、内关
B. 肾俞、肺俞
C. 市俞、足三里
D. 百会、神门
E. 脾俞、内关

正确答案：D。百会、神门

解析：遗尿伴有夜梦多应宁心安神，故应选用百会、神门等穴位（D对）。肾气不足配肾俞、命门、太溪；脾肺气虚配肺俞、气海、足三里；伴肝经郁热型配蠡沟、太冲。